逆行性牙髓炎往往伴随有
A. 严重的牙龈炎
B. 严重的牙周病
C. 严重的牙体缺损
D. 较深的楔状缺损
E. 明显的牙齿松动、移位

正确答案：B。严重的牙周病

解析：本题考查逆行性牙髓炎的诊断要点。逆行性牙髓炎的感染来源于患牙牙周炎所致的深牙周袋，袋内的细菌及毒素通过根尖孔或侧、副根管逆行进入牙髓，引起根部牙髓的慢性炎症，其诊断要点之一是患者患有严重的的牙周炎（B对）而不是严重的牙龈炎（A错）。严重的牙体缺损（C错）或较深的楔状缺损（D错）等牙体硬组织疾病引发的是正常的牙髓炎而不是逆行性牙髓炎。窄而深的牙周袋引起的逆行性牙髓炎不会引起明显的牙齿松动、移位（E错）。